关于宫颈癌的叙述，下列哪项是错误的
A. 可出现恶病质
B. 月道流血是常见症状
C. 早期宫颈癌常无症状
D. 有外生和内生两型
E. 宫颈刮片细胞学检查是最可靠的检查方法

正确答案：E。宫颈刮片细胞学检查是最可靠的检查方法

解析：早期宫颈癌常无症状及明显体征（C对），宫颈可光滑或与慢性宫颈炎无差异，随着病情发展可出现阴道排血、阴道排液及邻近器官的压迫症状。宫颈癌的早期多为接触性出血或血水样阴道分泌物，晚期为不规则阴道流血（B对）。出血量与病灶大小、侵及间质内血管有关，若侵蚀大血管可引起大出血。年轻患者也可表现为经期延长、经量增多；老年患者常为绝经后不规则阴道流血。一般外生型出血较早，量多；内生型癌出血较晚（D对）。晚期症状表现可根据癌灶累及范围出现不同的继发性症状。如尿频、尿急、便秘、下肢浮肿和腰痛等；癌肿压迫或累及输尿管时，出现输尿管梗阻、肾盂积水及尿毒症，晚期可有贫血、恶病质（A对）等全身衰竭症状。宫颈和宫颈管活组织检查为确诊宫颈癌及宫颈癌前病变的最可靠依据（E错，为本题正确答案）。